含挥发油类中药宜采用的干燥方法是
A. 烘干法
B. 阴干法
C. 炒干法
D. 曝干法
E. 晒干法

正确答案：B。阴干法

解析：本题考查的是炮制对各类药物的影响。含挥发油类中药宜采用的干燥方法是阴干（B对）。含挥发油的药材应及时加工处理，干燥宜阴干，加水处理宜‘抢水洗’，以免挥发油损失，对加热处理尤须注意温度的控制。